下列关于酶性质功能的叙述，正确的是
A. 生物体内的无机催化剂
B. 催化活性都需要特异的辅酶
C. 对底物都有绝对专一性
D. 能显著地降低反应活化能
E. 在体内发挥催化作用时，不受任何调控

正确答案：D。能显著地降低反应活化能

解析：酶的化学本质是蛋白质，其是生物体内存在着一类极为重要的生物催化剂（A错）。酶按分子组成可分为单纯酶和缀合酶，其中单纯酶仅由蛋白质组成，没有辅酶（B错），缀合酶发挥其催化活性需要特异的辅酶或辅基。有的酶仅对特定结构的底物有绝对专一性（C错）。酶与一般催化剂相比能显著地降低反应活化能（D对）。酶在体内发挥催化作用的过程受多种代谢物和激素的调节（E错）。